铸造全冠的适应证为
A. 固定义齿的固位体
B. 修改牙齿外形、恢复咬合
C. 后牙牙体严重缺损
D. 牙本质过敏严重伴牙体缺损
E. 以上都是

正确答案：E。以上都是

解析：本题考查铸造全冠的适应证。铸造全冠与牙体组织紧密贴合、固位力强、自身强度高，其适应证包括固定义齿的固位体（A对）、修改牙齿外形、恢复咬合（B对）、后牙牙体严重缺损（C对）以及牙本质过敏严重伴牙体缺损者（D对）（ABCD均对，故E为本题的正确答案）。